小脑幕切迹疝时，疝入小脑幕裂孔的组织是
A. 额叶内侧
B. 颞叶钩回
C. 顶叶下叶
D. 枕叶
E. 小脑扁桃体

正确答案：B。颞叶钩回

解析：常见的脑疝有三类，即颞叶钩回疝或小脑幕切迹疝、枕骨大孔疝或小脑扁桃体疝、大脑镰下疝或扣带回疝。不同类型的脑疝，其通过硬脑膜间隙和孔道的脑组织不同：小脑幕切迹疝时，疝入小脑幕裂孔的组织是颞叶的海马回、钩回（B对）；枕骨大孔疝时，疝入枕骨大孔的是小脑扁桃体和延髓；大脑镰下疝时，疝入镰下孔的是扣带回。